异烟肼的治疗方法，叙述错误的是
A. 早期轻症肺结核可单独使用
B. 预防用药时可单独使用
C. 规范化治疗时必须联合使用
D. 粟粒性结核加大剂量
E. 结核性脑膜炎减短疗程

正确答案：E。结核性脑膜炎减短疗程

解析：异烟肼对早期轻症肺结核或预防用药时可单独使用，规范化治疗时必须联合使用其他抗结核病药，以防止或延缓耐药性的产生。对粟粒性结核和结核性脑膜炎应加大剂量，延长疗程，必要时注射给药。掌握“异烟肼、利福平及乙胺丁醇”知识点。